使眼裂开大的肌肉是
A. 上直肌
B. 上斜肌
C. 内直肌
D. 眼轮匝肌
E. 上睑提肌

正确答案：E。上睑提肌

解析：上睑提肌（E对）收缩提上睑，使眼裂开打。